一侧翼内肌收缩可使下颌骨
A. 上提并向同侧运动
B. 上提并向对侧运动
C. 上提并向后方运动
D. 下降并向同侧运动
E. 下降并向对侧运动

正确答案：B。上提并向对侧运动

解析：一侧翼内肌收缩可使下颌骨上提并向对侧运动（B对）。